男，65岁。活动时心悸气短1年余。查体：胸骨左缘第3肋间可闻及舒张期叹气样杂音，向心尖部传导，周围血管征阳性。该患者心界叩诊最可能表现为
A. 向左下扩大，心腰凹陷
B. 向左扩大，心腰饱满
C. 向右侧扩大
D. 向两侧扩大
E. 正常

正确答案：A。向左下扩大，心腰凹陷

解析：胸骨左缘第3肋间（主动脉瓣第二听诊区）可闻及舒张期叹气样杂音，向心尖部传导，周围血管征阳性，提示主动脉瓣关闭不全。主动脉关闭不全时，左心室扩大，出现心界叩诊左下扩大，呈靴型心，心腰凹陷（A对）。向左扩大，心腰饱满（B错）提示左心房肥大。向右侧扩大（C错）罕见。向两侧扩大（D错）提示扩张性心肌病。